一患者不慎摔伤面部，临床检查及X线片提示下颌骨体部骨折，患者最不可能出现的症状是
A. 牙龈出血
B. 牙脱位
C. 颧部塌陷
D. 咬合错乱
E. 前牙开（牙合）

正确答案：C。颧部塌陷

解析：本题考查下颌骨骨折的临床表现。患者颌骨体部骨折，最不可能出现的症状是颧部塌陷（C错，为本题的正确答案）。颧骨颧弓骨折可表现为颧面部塌陷畸形、张口受限、复视、神经症状和眶周瘀斑。下颌骨骨折表现为骨折段移位，牙脱位（B对）、咬合错乱（D对），前牙开（牙合）（E对）、骨折段异常动度、下唇麻木、张口受限、牙龈撕裂出血（A对）等。